关于抗疟药，下列哪项叙述正确
A. 氯喹对阿米巴痢疾有效
B. 氯喹可根治间日疟
C. 青蒿素治疗疟疾易复发
D. 伯氨喹可用作疟疾病因性预防
E. 乙胺嘧啶能引起急性溶血贫血

正确答案：C。青蒿素治疗疟疾易复发